工人高某，在高尔夫球杆加工厂从事打磨工作8年，每天工作10小时以上，经常加班。最近几个月感觉手麻、手痛、手心出汗，持续性加重，抓握工具时感觉无力。经一般内、外科体检，未发现明显异常。这种情况下需考虑该工人是否罹患
A. 常见的肌肉骨骼损伤
B. 类风湿病
C. 肌肉劳损
D. 手臂振动病
E. 末梢神经炎

正确答案：D。手臂振动病